患者，男，50岁。咳嗽喘促，呼多吸少动则益甚，声低息微，腰膝酸软，舌淡，脉沉细的是
A. 肺气虚损
B. 肺阴虚亏
C. 肺肾气虚
D. 肺肾阴虚
E. 肾气虚衰

正确答案：C。肺肾气虚

解析：肺气亏损无腰膝酸软的表现（A错）。肺阴亏虚多有五心烦热、潮热盗汗、形体消瘦的表现，且无腰膝酸软的表现（B错）。肺为气之主、肾为气之根，肺司呼吸，肾主纳气，肺气虚者咳嗽喘促，宗气不足，故声低息微，肾气虚，肾虚不纳，故呼多吸少，腰膝失养，故腰膝酸软，动则耗气，肺肾更虚，故动则益甚，舌淡，脉沉细为气虚之象，故题中患者为肺肾气虚（C对）。肺肾阴虚有形体消瘦、口燥咽干、潮热盗汗的表现（D错）。肾气虚无咳嗽喘促，声低息微的表现（E错）。